下列均是皮下及肌肉囊虫病的特点，除了
A. 皮下可扪及直径约0.5cm～1cm大小椭圆形结节
B. 多在躯干及四肢
C. 数量由数个至数百个不等
D. 皮下小结与周围组织有明显粘连
E. 结节可先后分批出现

正确答案：D。皮下小结与周围组织有明显粘连

解析：皮下及肌肉囊虫病患者皮下可扪及直径约0.5cm-1cm圆形或卵圆形结节（A对），数量由数个到数百个不等（C对），先后分批出现（E对），与周围组织无粘连（D错，为本题正确答案），以头颈和躯干较多，四肢少见（B对）。